下列哪种情况称为负辐射
A. 当周围物体表面温度超过人体表面温度时，周围物体对人体发射热辐射
B. 当周围物体表面温度低于人体表面温度时，人体向周围物体散热
C. 当周围空气温度高于人体表面温度，人体散热困难
D. 当周围空气温度低于人体表面温度，人体容易散热
E. 以上都不是

正确答案：B。当周围物体表面温度低于人体表面温度时，人体向周围物体散热

解析：本题考查正负辐射的辨析。正负辐射的区别在于物体和人体温度的差别。热辐射从温度高的地方向温度低的地方传递。当周围物体温度高时，人体吸收物体的热量，为正辐射（A错）。当人体温度高的时候，人体热辐射流失到周围物体，称为负辐射（B对ACDE错）。